男，68岁，进行性排尿困难，尿线变细，饮酒后症状加重。该患者最可能的病因是
A. 前列腺增生
B. 尿道狭窄
C. 膀胱肿瘤
D. 尿道结石
E. 神经性膀胱

正确答案：A。前列腺增生

解析：老年男性患者，进行性排尿困难，尿线细，饮酒后症状可加重，考虑有急性尿潴留，患者老年男性，饮酒后加重，故该患者最可能的病因是前列腺增生（A对）。前列腺增生是老年男性排尿障碍原因中最为常见，饮酒可使前列腺突然充血、水肿，使其梗阻症状加重。尿道狭窄（B错）所致的尿潴留患者多有尿道损伤及感染病史。膀胱肿瘤（C错）主要表现为间歇性无痛性肉眼血尿，一般较少引起急性尿潴留。尿道结石（D错）典型表现为排尿困难、伴尿痛，一般不会表现为进行性障碍。神经性膀胱（E错）指由中枢或周围神经系统病变引起的膀胱功能障碍，多见于脊髓、马尾损伤、肿瘤、糖尿病等。